葛根黄芩黄连汤中配伍黄芩的用意是
A. 和解清热
B. 清热燥湿
C. 清热止血
D. 清热安胎
E. 凉血解毒

正确答案：B。清热燥湿

解析：本题考查葛根黄芩黄连汤的方解，属理解内容。葛根黄芩黄连汤中以苦寒之黄连、黄芩为臣，清热燥湿（B对），厚肠止利。黄芩的功效，清热燥湿、泻火解毒、止血、安胎。因此，主要取清热燥湿的功效。